下列不属于队列研究的特点的是
A. 属于观察法
B. 需要设立对照组
C. 能确证暴露与结局的因果联系
D. 由因及果的研究方法
E. 省时、省力、省钱

正确答案：E。省时、省力、省钱

解析：本题考查队列研究的特点。队列研究特点包括：1.属于观察法（A对）；2.设立对照组（B对）；3.由因及果的研究方法（D对）；4.检验暴露与结局的因果联系能力较强（C对）。省时、省力、省钱（E错，为本题正确答案）不属于队列研究的特点。